面部的无菌创口一般可早期拆线，由于面部血液循环丰富，生长力强，拆线的时间是
A. 术后2天
B. 术后5天
C. 术后10天
D. 术后14天
E. 术后20天

正确答案：B。术后5天

解析：本题考查创口的拆线时间。面部的无菌创口一般可早期拆线，由于面部血液循环丰富，生长力强，拆线的时间是术后5天（B对）。术后2天（A错）时间过短，伤口尚未愈合。术后10天（C错）可为口内的污染创口拆线，腭裂术后的创口缝线应延长至10天以上拆除，对于不合作的小儿患者，口内缝线可不必拆除，任其自行脱落。术后14天（D错）可为光刀手术的创口拆线。术后20天（E错）时间过久，不符合面部的无菌创口最佳拆线时间。